根据待分离物质与杂质的溶解度不同，用于分离提纯的方法是
A. 重结晶法
B. 硅胶柱色谱法
C. 分馏法
D. 升华法
E. 凝胶色谱法

正确答案：A。重结晶法

解析：本题考查的是中药化学成分的分离与精制。根据待分离物质与杂质的溶解度不同，用于分离提纯的方法是重结晶法（A对）。依据分离原理的不同，可有以下六种不同的分离原理，一是根据物质溶解度差别进行分离，例如，结晶法、重结晶法、水提醇沉法、醇提水沉法等；二是根据物质在两相溶剂中的分配比不同进行分离，例如，液-液萃取法、pH萃取法、柱色谱法等；三是根据物质的吸附性差别进行分离，例如，硅胶吸附色谱法（B错）、氧化铝吸附色谱法、活性炭吸附色谱法、聚酰胺吸附色谱法、大孔树脂吸附色谱法、高效液相色谱法等；四是根据物质分子大小差别进行分离，例如，凝胶色谱法（E错）、膜分离法、大孔树脂色谱法等；五是根据物质解离程度不同进行分离，例如，离子色谱法；六是根据物质的沸点进行分离，例如，分馏法（C错）。升华法（D错）：固体物质在受热时不经过熔融直接转化为气体状态，该气体遇冷后又凝结成固体的现象称为升华。中药中有一些成分具有升华的性质，能利用升华法直接从中药中提取出来。如樟木中的樟脑，茶叶中的咖啡因等。